下列哪项是月经后期的临床常见证型
A. 血寒
B. 虚热
C. 阴虚
D. 肝郁
E. 气虚

正确答案：A。血寒

解析：月经后期常见证型包括肾虚证，血虚证，血寒证，气滞证。血寒导致月经后期有虚寒有实寒，虚寒者多由素体阳虚，或久病伤阳，阳虚内寒，脏腑失于温养，生化失期，气虚血少，冲任亏虚，血海不能如期满溢，遂致经行后期。实寒者，多由经期产后，外感寒邪，或过食寒凉，寒博于血，血为寒凝，冲任阻滞，血海不能如期满溢，遂致月经后期，故血寒证为月经后期的常见证型（A对）。